患者，男，39岁。阳事临房举而不坚，腰膝酸软，面色苍白，头晕目眩，舌淡，脉沉细。用药宜首选
A. 虫草、蛤蚧
B. 肉苁蓉、锁阳
C. 淫羊藿、巴戟天
D. 沙苑子、菟丝子
E. 紫河车、狗脊

正确答案：C。淫羊藿、巴戟天

解析：患者房事不举，腰膝酸软，面色苍白，头晕目眩，舌淡，脉沉细，为肾阳虚的表现；应当温补肾阳，益精血；淫羊藿、巴戟天补肾阳之力强，为首选药物（C对A错）。冬虫夏草：补肾益肺，止血化痰。蛤蚧：补肺益肾，纳气平喘，助阳益精（B错）。肉苁蓉：补肾阳，益精血，润肠通便。锁阳：补肾阳，益精血，润肠通便。温补肾阳作用较淫羊藿、巴戟天较弱（D错）。沙苑子：补肾助阳，固精缩尿，养肝明目。菟丝子：补益肝肾，固精缩尿，安胎，明目，止泻（E错）。紫河车：温肾补精，益气养血。狗脊：祛风湿，补肝肾，强腰膝。